抢救新生儿窒息和一氧化碳中毒的首选呼吸兴奋药是
A. 咖啡因
B. 尼可刹米
C. 回苏灵
D. 山梗菜碱
E. 士的宁

正确答案：D。山梗菜碱

解析：洛贝林又名山梗菜碱（D对），可兴奋颈动脉体和主动脉体的化学感受器，反射性兴奋延髓呼吸中枢，临床可用于抢救新生儿窒息、一氧化碳中毒以及小儿感染性疾病引起的呼吸衰竭等。咖啡因（A错）可兴奋大脑皮质，临床常用于中枢抑制状态如吗啡过量引起的呼吸抑制，镇定催眠药或抗组胺药过量引起的昏睡及呼吸、循环抑制、偏头痛等。尼可刹米（B错）又名可拉明，治疗量可直接兴奋延髓呼吸中枢，临床用于各种原因引起的呼吸抑制，对肺心病引起的呼吸衰竭及吗啡中毒引起的呼吸抑制疗效较好。二甲弗林又名回苏灵（C错），主要用于各种原因引起的中枢性呼吸衰竭、麻醉药、催眠药所致的呼吸抑制及外伤、手术等引起的休克。士的宁（E错）可选择性兴奋骨髓，增强骨骼肌的紧张度，由于毒性较大，目前已较少使用于临床。